河豚毒素含量最多的部位是
A. 肌肉
B. 皮肤
C. 卵巢
D. 脾
E. 肾

正确答案：C。卵巢